下列提示胎盘功能正常的情况是
A. 血清胎盘生乳素突然降低50%
B. 胎动＜10次/2小时
C. OCT试验阳性
D. 尿雌激素/肌酐比值＞15
E. NST试验无反应型

正确答案：D。尿雌激素/肌酐比值＞15

解析：尿雌激素/肌酐比值可反应胎盘功能，>15为正常值，10～15为警戒值，<10为危险值（D对）。足月妊娠血清胎盘生乳素值为4～11mg/L，若该值于足月妊娠时<4mg/L，或突然降低50％，提示胎盘功能低下（A错）。妊娠28周以后，胎动计数<10次/2小时或减少50％者提示有胎儿缺氧可能（B错）。OCT试验（缩宫素激惹试验）阳性：≧50％的宫缩伴随晚期减速（C错）。NST试验（无应激试验）无反应型表明胎儿宫内储备能力差（E错）。